良性肿瘤对机体影响最大的因素是
A. 生长部位
B. 生长速度
C. 组织来源
D. 生长时间
E. 体积大小

正确答案：A。生长部位

解析：本题考查口腔颌面部肿瘤的临床表现-良性肿瘤。良性肿瘤对机体影响最大的因素是生长部位（A对），如生长在要害部位或发生并发症时，可危及生命。良性肿瘤生长速度（B错）一般较慢，早期可无明显症状，只有瘤体生长较大时，才会产生压迫症状；组织来源（C错）是描述肿瘤细胞来源于上皮细胞或间叶细胞；生长时间（D错）可在一定程度上决定良性肿瘤大小，但不是良性肿瘤对机体影响最大的因素；体积大小（E错）可决定是否产生压迫症状或阻塞症状，但不是良性肿瘤对机体影响最大的因素。